以下哪项不正确
A. 恶性肿瘤组织来源不同，治疗方法各异
B. 根据肿瘤侵犯的范围，国际抗癌协会制定了TNM分类法
C. T表示原发肿瘤
D. N表示肿瘤大小
E. M表示有无远处转移

正确答案：D。N表示肿瘤大小

解析：本题考查TNM分类法。N表示肿瘤大小（D错，为本题的正确答案）不正确。恶性肿瘤组织来源不同，治疗方法各异（A对）。根据肿瘤侵犯的范围，国际抗癌协会制定了TNM分类法（B对），其中T表示原发肿瘤（C对），N表示区域性淋巴结，不是肿瘤大小，M表示有无远处转移（E对）。